对重症急性胰腺炎的诊断最有意义的检查是
A. 尿淀粉酶
B. 腹部B超
C. 腹部增强CT
D. 血淀粉酶
E. 血清脂肪酶

正确答案：C。腹部增强CT

解析：腹部增强CT（C对）不仅能诊断急性胰腺炎，而且能鉴别是否合并胰腺组织坏死，同时对其并发症如胰腺脓肿、假性囊肿等也有重要诊断价值。在胰腺弥漫性肿大的背景上若出现质地不均、液化和蜂窝状低密度区，则可诊断为胰腺坏死。尿淀粉酶（A错）、血淀粉酶（D错）、血清脂肪酶（E错）等胰酶测定是诊断胰腺炎的常用方法，但上述指标的变化与病变的严重程度不呈正相关，不能用于判断病情的轻重。腹部B超（B错）为急性胰腺炎的首选影像学检查方法，经济简便易行，但由于上腹部肠气干扰，诊断的准确性常受影响。